患者，女，40岁。双乳肿块界限不清，经前乳房胀痛，伴有月经不调，腰酸乏力，舌质淡红，苔白，脉细。治疗应首选
A. 左归丸
B. 开郁散
C. 逍遥贝蒌散
D. 二仙汤合四物汤
E. 六味地黄汤

正确答案：D。二仙汤合四物汤

解析：乳癖的特点为单侧或双侧乳房疼痛并出现肿块，乳痛和肿块与月经周期及情志变化密切相关。乳房肿块大小不等，形态不一，边界不清，质地不硬，活动度好，题中病例患者双乳肿块界限不清，经前乳房胀痛，伴有月经不调，故诊断为乳癖。经前乳房胀痛，月经不调，腰酸乏力为冲任失调所致，舌质淡红，苔白，脉细符合冲任失调的舌脉，故辨为冲任失调证，治宜调摄冲任。左归丸功能滋阴补肾，填精益髓，主治真阴不足证（A错）。开郁散功能开郁散结，主治肝胆郁结之瘰疬（B错）逍遥蒌贝散用于治疗乳癖肝郁痰凝证，功能疏肝解郁，化痰散结（C错）。乳癖冲任失调证治宜调摄冲任，方用二仙汤合四物汤（D对）。六味地黄丸功能滋补肝肾，主治肝肾阴虚证（E错）。